面神经受损
A. 1岁之内患儿患化脑易合并
B. 结核性脑膜炎
C. 脑膜炎双球菌脑炎
D. 新生儿化脓性脑膜炎
E. 肺炎链球菌性脑膜炎

正确答案：B。结核性脑膜炎

解析：结核性脑膜炎的临床表现为脑神经损害：颅底炎性渗出物的刺激、粘连、压迫，可致脑神经损害，以动眼、外展、面和视神经最易受累，表现视力减退、复视和面神经麻痹等（B对）。脑膜炎双球菌脑炎主要临床表现有发热，头痛、呕吐、皮肤瘀点及颈项强直等脑膜刺激征，脑脊液呈化脓性改变（C错）。新生儿化脓性脑膜炎表现为感染症状、脑膜刺激征、颅内压增高、局灶症状，部分患者可出现局灶性神经功能损害的症状，如偏瘫、失语等，其他症状（AD错）。肺炎链球菌性脑膜炎中脑神经损害占50%，常累及动眼神经、面神经（E错）。